问卷法是社会医学的重要研究方法之一。问卷是由组问题和相应答案所构成的表格，问卷设计的好坏将影响所收集到的资料的有效性及可信度，从而影响问卷调查的效果。问卷设计的最关键一步是
A. 确定研究目的
B. 确定数据收集方法
C. 确定调查对象
D. 确定问卷条目
E. 确定问卷答案

正确答案：A。确定研究目的